女，30岁，经产妇，自然分娩后1天，下腹阵发性疼痛，查体：T37.6℃，宫底平脐，质硬，无压痛，阴道有暗红色流血，少于月经量，首先考虑的诊断是
A. 正常产褥
B. 产后出血
C. 子宫复旧不良
D. 产褥中暑
E. 产褥感染

正确答案：A。正常产褥

解析：经产妇，自然分娩后1天，T37.6℃（体温略高），宫底平脐，质硬，无压痛（子宫复旧），下腹阵发性疼痛（产后宫缩痛），阴道有暗红色流血，少于月经量，首先考虑的诊断是正常产褥（A对）。产后出血（B错）指胎儿娩出后24小时内，下腹阵发性疼痛，阴道分娩者出血量≥500ml，剖宫产者≥1000ml(P204）。子宫复旧不良（C错）可扪及子宫增大、变软，宫口松弛，有时可触及残留组织和血块(P222）。产褥中暑（D错）表现为高热、水电解质紊乱，循环衰竭和神经系统功能损害等（P217）。产褥感染（E错）三大主要症状：发热、疼痛、异常恶露（P219）。